免疫性非溶血性发热性输血反应的主要原因和发病机制是
A. 输入血液中的白细胞和患者血浆中的白细胞抗体发生免疫反应
B. 输入血液中的红细胞和患者血浆中相应抗体发生免疫反应
C. 输入血液中的血小板和患者血浆中相应抗体发生免疫反应
D. 输入血液中的血浆蛋白在患者体内引起过敏反应
E. 输入血液中污染的热原质导致发热性反应

正确答案：A。输入血液中的白细胞和患者血浆中的白细胞抗体发生免疫反应

解析：免疫性非溶血性发热性输血反应常见于经产妇或多次接受输血者，因体内已有白细胞或血小板抗体，当再次输血时可与输入的白细胞或血小板发生抗原抗体反应而引起发热，其中由于白细胞而引发的发热占大多数（A对BCD错）。输入血液中污染的热原质导致发热性反应不是免疫反应（E错）。